随着抗生素广泛应用，引起细菌性肺炎的病原体最主要的变化是
A. 肺炎球菌肺炎不断增加
B. 革兰阴性杆菌肺炎不断增加
C. 军团菌肺炎的发病率逐年下降
D. 葡萄球菌肺炎很少发生
E. 支原体肺炎很少发生

正确答案：B。革兰阴性杆菌肺炎不断增加

解析：近年来随着抗生素的广泛应用，细菌性肺炎的病原体分布发生了一些变化（七版内科学呼吸系统总论P6）：1.革兰阴性杆菌肺炎的比例不断增加，已经成为医院内肺炎的首要致病菌（B对）。2.肺炎链球菌仍是主要病原体，但比例不断下降（A错）。3.非典型病原体（如肺炎支原体、肺炎衣原体、肺炎军团菌）所占比例在增加（CE错）。4.葡萄球菌肺炎并不少见，为医院内肺炎的次常见病原菌（D错）。